以下都是环境毒理学在环境因素对健康影响的研究中的优点，哪项除外
A. 人为地控制化学物的暴露剂量
B. 人为地控制化学物的暴露时间
C. 更能反映对人的有害效应
D. 可应用特殊基因型的细胞、转基因动物等试验材料进行研究
E. 效应观察的指标不受限制

正确答案：C。更能反映对人的有害效应

解析：本题考查环境毒理学在环境因素对健康影响的研究中的优点。环境毒理学研究方法的优点包括人为地控制暴露水平和强度（AB对）；可应用特殊基因型的细胞、转基因动物等试验材料进行研究（D对）；效应观察的指标不受限制（E对）。更能反映对人的有害效应（C错，为本题正确答案）不是环境毒理学研究方法的优点。